我国目前将职业性致癌物分为三类，即
A. 确认致癌物、可疑致癌物和潜在致癌物
B. 人类致癌物、动物致癌物和其他致癌物
C. 人类致癌物、动物致癌物和可疑致癌物
D. 人类致癌物、动物致癌物和潜在致癌物
E. 确认致癌物、可疑致癌物和非致癌物

正确答案：A。确认致癌物、可疑致癌物和潜在致癌物